疾病预防控制机构应当依照国务院卫生主管部门的规定，建立真实、完整的，购进、储存、分发、供应记录，做到票、账、货、款一致，并保存至（）备查
A. 三年
B. 不得少于五年
C. 超过疫苗有效期2年
D. 1年
E. 六年

正确答案：C。超过疫苗有效期2年